住宅环境对健康影响的特点
A. 主要是影响人们的生活、居住、学习、工作
B. 主要是影响小气候
C. 主要是具有长期性和复杂性，表现为慢性、潜在性和功能上的不良影响
D. 主要是对新迁入居住的家庭成员的健康产生影响
E. 主要是影响日照、采光、噪声、绿化和空气清洁状况等

正确答案：C。主要是具有长期性和复杂性，表现为慢性、潜在性和功能上的不良影响

解析：本题考查住宅环境对健康影响的特点。住宅环境对健康的影响具有长期性和复杂性。住宅内的环境卫生问题，在通常情况下，室内单一污染物的浓度并不太高，不易在较短的时间内对健康产生有害影响，因而其对健康的影响往往表现为慢性、潜在性和功能上的不良影响（C对ABDE错）。